分娩前母亲使用氯霉素可引起新生儿出现
A. 智力障碍
B. 血钙升高
C. 电解质紊乱
D. 牙齿黄染
E. 灰婴综合征

正确答案：E。灰婴综合征

解析：本题考查氯霉素的不良反应。分娩前母亲使用氯霉素可引起新生儿出现“灰婴综合征”（E对）。氯霉素能够透过胎盘屏障，对早产儿和足月产新生儿均可能引起毒性反应，发生“灰婴综合征”。